有中枢兴奋性作用的药物是
A. 醛固酮
B. 氢化可的松
C. 倍他米松
D. 地塞米松
E. 氟轻松

正确答案：B。氢化可的松

解析：氢化可的松（B对）可减少脑内抑制性神经递质γ-氨基丁酸的浓度，提供中枢系统的兴奋性，用药后可出现欣快、激动、失眠等，偶尔可诱发精神失常，大剂量对儿童可致惊厥或癫痫样发作。醛固酮（A错）属于盐皮质激素，具有调节水盐代谢的作用，可促进肾远曲小管对钠离子的主动吸收，伴有氯离子和水的重吸收，临床可用于肾上腺皮质功能减退症以纠正患者失钠、失水和钾潴留等，恢复水和电解质平衡，无中枢兴奋作用。倍他米松（C错）、地塞米松（D错）、氟轻松（E错）属于糖皮质激素药物，具有强大的抗炎、抗过敏、免疫抑制等作用，无中枢兴奋作用，其中倍他米松和地塞米松为在泼尼松龙的9位碳上引入氟，16位碳上引入甲基，其抗炎作用明显提高，水钠潴留作用减弱。氟轻松是在泼尼松恭的6位碳和9位碳上同时引入氟，其抗炎作用和水钠潴留的作用都明显增强，只能用于皮肤的局部抗炎。